心脏骤停最重要的诊断依据是
A. 心音消失
B. 手足抽搐
C. 桡动脉搏动消失
D. 呼吸断续
E. 呼之不应

正确答案：A。心音消失

解析：心脏骤停是心脏泵血功能的突然停止，偶有自行恢复，但通常会导致死亡，心脏骤停后，脑血流量急剧减少，可导致意识突然丧失，其症状和体征出现依次为心音消失→脉搏扪不到、血压测不出→意识突然丧失或伴有短阵抽搐（E错），抽搐常为全身性，多发生于心脏停搏后10秒内，有时伴有眼球偏斜（B错）→呼吸断续，呈叹息样，以后即停止，多发生在心脏停搏30秒后（D错）→瞳孔散大，多在心脏停搏后30~60秒出现，同时可有皮肤苍白或发绀、大小便失禁等，其最重要的诊断依据是心音消失（A对），最可靠的临床表现为意识突然丧失伴大动脉搏动消失。